某医学院曾收治三例分别在院外接受过试验性肝穿刺引起急性腹膜炎的病人。术中医生在抽出脓液5～10ml后，即拔除穿刺针，术后未作常规处理，2小时后呈急腹症症状。结果二例治愈，一例死亡。对试验性肝穿刺的下列说法中错误的是
A. 肝穿刺应该由有训练的医生进行，一定要避免盲目性和危险性
B. 在试验之前做过动物试验
C. 只要动机是好的，虽然是事故，它也有一定的正价值
D. 医学研究的试验设计必须严密
E. 试验前必须经有关专家审定是符合科学要求

正确答案：C。只要动机是好的，虽然是事故，它也有一定的正价值

解析：涉及人的生物医学研究的目的是为了研究人体的生理机制、疾病的发生和发展机制，以及采取的干预措施的安全性和有效性，以改进和提高疾病的防治水平，达到促进医学科学发展和维护、增进人类的健康。那些以研究为名，纯粹追求个人的经济利益、名誉声望、权势地位的做法，是完全违背上述目的的，也是不符合医学科研伦理甚至是违法的。掌握“医学科研伦理的含义和要求”知识点。